关于闭式胸腔引流的描述正确的是
A. 拔管时在病人深呼气屏气时拔除引流管
B. 插管部位在腋中线与腋后线之间第6或7肋间隙
C. 引流管深入胸腔约3～5cm
D. 闭式引流要保证胸腔内气液体克服5～6cm的水柱
E. 每日要现察导管是否通畅与流的质和量

正确答案：E。每日要现察导管是否通畅与流的质和量

解析：胸腔闭式引流术主要用于中大量气胸、开放性气胸、张力性气胸及部分血胸的治疗，气胸引流一般在前胸壁锁骨中线第2肋间隙，血胸则在腋中线与腋后线间第6或7肋间隙（B错）。引流管的侧孔应深入胸腔内2～3cm（C错）。引流管外接闭式引流装置，保证胸腔内气、液体克服3～4cmH₂O（D错）的压力能通畅引流出胸腔，而外界空气、液体不会吸入胸腔。术后经常挤压引流管以保持管腔通畅，记录每小时或24小时引流液量（E对）。引流后肺膨胀良好，已无气体和液体排出，可在病人深吸气屏气时拔除引流管（A错），并封闭伤口。